对咳嗽的正确论述是
A. 多由外感邪气而引发
B. 是老年人的常见病
C. 是多种疾患的病理表现
D. 是体虚者的常见病症
E. 是一种损伤性的生理反射

正确答案：C。是多种疾患的病理表现